下列哪项是支气管哮喘呼吸困难的类型
A. 呼气性
B. 吸气性
C. 混合性
D. 阵发性
E. 腹式呼吸消失

正确答案：A。呼气性

解析：支气管哮喘表现为呼气性呼吸困难（A对）。吸气性呼吸困难常见于喉部、气管、大支气管的狭窄与阻塞（B错）。混合性呼吸困难见于重症肺炎、重症肺结核、大面积肺栓塞、弥漫性肺间质疾病、大量胸腔积液、气胸、广泛性胸膜增厚等（C错）。阵发性呼吸困难见于左心衰等（D错）。腹式呼吸消失见于腹膜炎症、腹水、急性腹痛等（E错）。